有关高血压并发症，下列哪项不正确
A. 心、脑、肾等器官是主要受累脏器
B. 眼底病变与高血压的严重程度直接有关
C. 恶性高血压以脑并发症最为突出
D. 脑卒中的发病率比心肌梗死高5倍左右
E. 高血压脑病症状出现可能与脑水肿有关

正确答案：C。恶性高血压以脑并发症最为突出

解析：患者发生恶性高血压时舒张压持续≥130mmHg，肾脏损害突出，表现为持续蛋白尿、血尿与管型尿，故恶性高血压以肾脏并发症最为突出，而不是脑（C错，为本题正确答案）。高血压主要累及的脏器为心、脑、肾（A对）。眼底小动脉为唯一可以从体表观察的小动脉，根据对眼底血管病变的观察可了解高血压血管病变，帮助判断高血压的严重程度（B对）。长期高血压使脑血管发生缺血与变性，形成微动脉瘤，一旦破裂可发生脑出血。临床相关数据显示，脑卒中的发病率比心肌梗塞高5倍左右（D对）。高血压脑病发病机制之一为血压过高，使脑部血管灌注增多，毛细血管压力过高，渗透性增强，导致脑水肿（E对）。